阿司匹林没有哪种作用
A. 解热作用
B. 消炎作用
C. 抗风湿作用
D. 高剂量时才能抑制血小板聚集
E. 高剂量时也能抑制PGI2的合成

正确答案：D。高剂量时才能抑制血小板聚集

解析：阿司匹林药理作用：①镇痛作用；②消炎作用；③解热作用；④抗风湿作用；⑤对血小板聚集的抑制作用（低浓度阿司匹林就能够降低血栓素A2的浓度及抗血栓形成）。掌握“阿司匹林”知识点。